缝合舌组织创伤的方法中，错误的是
A. 使用较粗缝线缝合
B. 尽量保持舌的纵长度
C. 边距要大，缝得要深
D. 可将舌尖向后折转缝合
E. 创伤累及相邻组织时，应分别缝合

正确答案：D。可将舌尖向后折转缝合

解析：本题考查缝合舌组织创伤的方法。缝合舌组织创伤的方法中错误的是可将舌尖向后折转缝合（D错，为本题的正确答案）。舌组织较脆，活动度大，损伤后肿胀明显，缝合处易于撕裂，应采用较粗的线（4号以上的线）进行缝合（A对），进针距窗创缘要大于5mm，深度要深（C对），以防止因肿胀而使创口裂开或缝线松脱。舌组织有缺损时，缝合创口应尽量保持舌的纵长（B对），不可将舌尖向后折线缝合，防止因舌体变短而影响舌的发音功能。如舌的创伤累及邻近牙龈或舌腹与口底黏膜时，应分别缝合各自的创口（E对），以免日后舌组织与口底黏膜粘连影响舌的运动。